地图舌的临床表现
A. 舌背部脑回状或叶脉状皱褶
B. 舌背中部丝状乳头增生呈麦浪状
C. 舌背乳头萎缩与增生并存似蜿蜒国界
D. 舌背丝状乳头萎缩甚至消失
E. 舌背后部似菱形的舌乳头萎缩

正确答案：C。舌背乳头萎缩与增生并存似蜿蜒国界

解析：本题考查唇、舌疾病。地图舌的临床表现为舌背乳头萎缩与增生并存似蜿蜒国界（C对）。地图舌：又称地图样舌，是一种浅表性非感染性的舌部炎症。因其表现类似地图上标示的蜿蜒国界而得名。其病损的形态和位置多变，又被称为游走性舌炎。好发于舌背、舌尖、舌缘部，病损多在舌前2/3，一般不越过人字沟。病损由周边区和中央区组成。中央区表现为丝状乳头萎缩呈剥脱样，黏膜表面光滑、充血发红且微凹。周边区表现为丝状乳头增厚、呈黄白色条带状或弧线状分布，宽约数毫米，与周围正常黏膜形成明晰的分界。